女童，6岁。46萌出1/3，Ⅴ早失，ⅣMOD银汞充填体完好，做过完善根管治疗。应选择的保持器是
A. 带环丝圈保持器
B. 全冠丝圈保持器
C. 带环远中导板保持器
D. 全冠远中导板保持器
E. 活动功能式保持器

正确答案：D。全冠远中导板保持器

解析：单个牙早失，第一恒磨牙萌出不全应选远中导板保持器。由于基牙大面积充填体，选用全冠增加固位。掌握“乳牙早失及间隙管理”知识点。